甲肝的平均潜伏期为
A. 15天
B. 20天
C. 25天
D. 30天
E. 35天

正确答案：D。30天

解析：本题考查甲肝的潜伏期。甲肝…的潜伏期为15～50天，平均为30天（D对ABCE错）。